可能引起持续性干咳的抗高血压药是
A. 阿利克仑
B. 氨氯地平
C. 卡托普利
D. 硝普钠
E. 甲基多巴

正确答案：C。卡托普利

解析：本题考查抗高血压药。卡托普利（C对）为血管紧张素转换酶抑制剂（ACEI），ACEI的典型不良反应为长期干咳、胸痛、皮炎等。甲基多巴（E错）长期服用可致男性乳房增大。硝普钠（D错）不良反应包括药物急性过量反应和药物代谢产物的毒性反应。阿克利仑（A错）慎用于妊娠及哺乳期妇女。氨氯地平（B错）常见不良反应有头痛和脚踝水肿。